下列说法正确的是
A. 特异度也称真阴性率
B. 特异度也称假阴性率
C. 特异度也称真阳性率
D. 特异度也称假阳性率
E. 特异度与灵敏度之和等于符合率

正确答案：A。特异度也称真阴性率

解析：本题考查真实性评价指标。特异度也称真阴性率（A对BCDE错），即实际无病且被筛检试验标准判断为阴性的百分比。它反映了筛检试验鉴别排除病人的能力。